在染色体畸变实验中，染色体结构的改变不能观察到
A. 断片
B. 微小体
C. 微核
D. 染色体环

正确答案：C。微核

解析：本题考查染色体畸变实验。染色体畸变实验又称为细胞遗传学实验，是利用显微技术直接观察细胞中期染色体损伤的方法。在试验中，染色体结构的改变可观察到断片（A对）、微小体（B对）、染色体环（D对）。微核（C错，为本题正确答案）可在微核实验中观察到。